镰刀菌毒素中具有类雌激素样作用的是
A. 单端孢霉烯族化合物
B. 玉米赤霉烯酮
C. 丁烯酸内酯
D. 伏马菌素
E. 雪腐镰刀菌烯醇

正确答案：B。玉米赤霉烯酮

解析：本题考查具有类雌激素样作用的镰刀菌毒素。玉米赤霉烯酮（B对ACDE错）具有类雌激素样作用，可表现出生殖系统毒性作用。